网状结构
A. 种系发生上较新
B. 借特异性投射系统与大脑皮质相联系
C. 细胞排列密集
D. 其内有许多重要的"生命中枢"
E. 与上行感觉传导束无关

正确答案：D。其内有许多重要的"生命中枢"

解析：在脑干，除了明显的脑神经核、中继核和长的纤维束外，尚有神经纤维纵横交织成网状，其间散在有大小不等的神经细胞核团的结构，称脑干网状结构。网状结构种系发生上较老（A错），在高级脊椎动物中，不仅未消失反而得到了高度发达，与觉醒、睡眠周期节律等多种活动有关。网状结构核团内的细胞并非排列密集（C错），大致可分为向小脑投射的核群、中缝核群、内侧（中央）核群和外侧核群。其中内侧核群主要接受外侧核群、脊髓和所有脑神经感觉核的传入纤维，因而与上行感觉传导束有关（E错）。脑干网状结构的功能组合中，一方面经脑干上行的各种特异性感觉传导束可终止于背侧丘脑的非特异性核团及下丘脑，而后广泛地投射到大脑皮质（B错），把特异性的感觉信息转化为非特异性的信息，使大脑皮质保持适度的意识和清醒，从而对各种传入信息有良好的感知能力。另一方面网状结构内存在着由许多调节内脏活动的神经元，构成呼吸中枢和心血管运动中枢等重要的生命中枢（D对），因而脑干损伤可能导致生命中枢受损，危及生命。